胰腺癌特异性肿瘤标记物是
A. CEA
B. AFP
C. CA199
D. CA125
E. 碱性磷酸酶

正确答案：C。CA199

解析：CA199是胰腺癌的首选肿瘤标志物，连续检测对病情进展、手术疗效、预后估计及复发诊断有重要价值（C对）。CEA（A错）是一种广谱性肿瘤标志物，可在多种肿瘤中表达，脏器特异性低，在临床上主要用于辅助恶性肿瘤的诊断判断预后、监测疗效和肿瘤复发等。AFP（B错）对诊断肝细胞癌及滋养细胞恶性肿瘤有重要的临床价值。CA125（D错）一般用于诊断卵巢癌、盆腔肿瘤鉴别等，肝硬化失代偿期也有明显提升。血碱性磷酸酶升高（E错）见于肝损伤、骨肿瘤和恶性肿瘤骨转移等。